8岁小儿重度贫血的诊断指标是
A. Hb大于120g/L
B. Hb90～120g/L
C. Hb60～90g/L
D. Hb30～60g/L
E. Hb小于30g/L

正确答案：D。Hb30～60g/L

解析：8岁小儿年龄界限在5～11岁之间，故其Hb正常值为115g/L，而重度贫血的Hb含量常为30～60g/L（D对）。